咽鼓管
A. 内侧1/3为骨部
B. 外侧2/3为软骨部
C. 咽鼓管咽门开口于咽隐窝
D. 咽鼓管向后外开口于鼓室前壁
E. 无

正确答案：D。咽鼓管向后外开口于鼓室前壁

解析：咽鼓管全长的外1/3为咽鼓管骨部（A错），内侧2/3为软骨部（B错）。咽鼓管咽口，平对下鼻甲后方（C错）。咽鼓管向后外侧开口于鼓室前壁（D对）的咽鼓管鼓室口。